属于维生素K拮抗剂的抗凝血药物是
A. 依诺肝素
B. 氯吡格雷
C. 华法林
D. 利伐沙班
E. 达比加群酯

正确答案：C。华法林

解析：本题考查华法林。属于维生素K拮抗剂的抗凝血药物是华法林（C对）。华法林属于维生素K拮抗剂的抗凝血药物，可抑制羧基化酶，适用于预防、治疗深静脉血栓及肺栓塞，预防心肌梗死后、心房颤动、心瓣膜疾病或人工瓣膜置换术后引起的血栓栓塞并发症。依诺肝素（A错）用于预防深静脉血栓形成。氯吡格雷（B错）是二磷酸腺苷P2Y12受体阻断剂，抑制血小板聚集。利伐沙班（D错）属于凝血因子Xa直接抑制剂的抗凝药，可直接抑制Xa因子，阻断凝血酶原转化为凝血酶，但不影响已形成的凝血酶活性。达比加群酯（E错）是直接凝血酶抑制剂(DTIs），用于预防非瓣膜性房颤患者的卒中和全身性栓塞。